肝藏血的生理功能是指肝有
A. 贮藏血液
B. 调节血量
C. 统摄血液
D. 贮藏血液和调节血量
E. 化生血液与统摄血液

正确答案：D。贮藏血液和调节血量

解析：本题考查肝藏血的生理功能的含义，属于理解记忆内容。肝藏血，是指肝脏具有贮藏血液、调节血量和防止出血的功能，A选项与B选项内容不及D选项全面（D对，AB错）。血的正常运行，虽由心所主持，但与肝、脾也有密切的关系。肝主藏血，调节血量；脾主生血，统摄血液，所以肝不具有统摄血液的作用（CE错）。